患儿，女，3个月。口腔舌面满布白屑，面赤唇红，烦躁不宁，吮乳啼哭，大便干结，小便短黄。治疗应首选制霉菌素加
A. 清热泻脾散
B. 泻黄散
C. 六味地黄丸
D. 导赤散
E. 清胃散

正确答案：A。清热泻脾散

解析：患儿以“口腔舌面满布白屑”为主症，故诊断为鹅口疮。婴儿胎热内盛，或感受秽毒之邪，或久病余热未清，蕴积心脾，热毒循经上行，熏灼口舌，故出现口腔舌面满布白屑；火热上炎，故面赤唇红；心火内炽，故烦躁不宁，吮乳啼哭；火热伤津，故大便干结；心移热于小肠，故小便短黄，故其证候为心脾积热证，治以清心泻脾，方药为清热泻脾散（A对）。泻黄散（B错）其功用为泻脾胃伏火，可用于小儿弄舌等症。六味地黄丸（C错）加肉桂，共起滋阴降火，引火归元的作用，适应于疱疹性口炎虚火上浮证。导赤散（D错）其功用为清心利水养阴，适用于心经火热证。清胃散（E错）其功用为清胃凉血，适用于胃火牙痛。